香附性平，除能疏肝理气外，还能
A. 开郁醒脾
B. 健脾消食
C. 通阳散结
D. 活血止痛
E. 调经止痛

正确答案：E。调经止痛

解析：本题考查的是香附的功效。香附性平，除能疏肝理气外，还能调经止痛（E对）。香附：【功效】疏肝理气，调经止痛。甘松：【功效】行气止痛，开郁醒脾（A错）。木香：【功效】行气止痛，健脾消食（B错）。薤白：【功效】通阳散结（C错），行气导滞。玫瑰花：【功效】行气解郁，活血止痛（D错）。